社会因素影响健康的门户是
A. 感知觉系统
B. 神经
C. 神经-内分泌
D. 神经-内分泌-免疫系统
E. 大脑

正确答案：A。感知觉系统